促使轴突末梢释放神经递质的离子是
A. K⁺
B. Na⁺
C. Ca²⁺
D. Cl⁻
E. H⁺

正确答案：C。Ca²⁺

解析：在突触传递过程中，当突触前神经元的兴奋传到末梢时，突触前膜去极化，当去极化达一定水平时，突触前膜中的电压门控钙通道开放，Ca²⁺从细胞外进入突触前末梢轴浆内，导致轴浆内Ca²⁺浓度瞬时升高，升高的Ca²⁺（C对）可触发突触囊泡的出胞，促使轴突末梢释放神经递质。